肺心病肺动脉高压形成的解剖因素是
A. 慢性缺氧所致肺血管重建
B. 缺氧性肺血管收缩
C. 支气管肺感染和阻塞
D. 血液粘稠度增加
E. 气道炎症

正确答案：A。慢性缺氧所致肺血管重建

解析：肺血管阻力增加的解剖学因素系指肺血管解剖结构的变化，形成肺循环血流动力学障碍。慢性缺氧所致肺血管重建（A对），是由于肺血管解剖结构的变化，引起慢性缺氧性肺动脉高压。肺血管阻力增加的功能性因素是指缺氧、高碳酸血症和呼吸性酸中毒使肺血管收缩、痉挛，其中缺氧是最重要的因素，称为缺氧性肺血管收缩（B错）。支气管肺感染和阻塞（C错）为阻塞性肺炎的病理改变。血液粘稠度增加（D错）是引起肺动脉高压的血流动力学因素，它既不属于功能性因素，也不属于解剖学因素。气道炎症（E错）为支气管哮喘的本质。